关于平喘药物的作用，哪一项是错误的
A. 稳定肥大细胞膜
B. β2受体激动
C. 磷酸二酯酶抑制
D. M受体阻断
E. 直接松弛支气管平滑肌

正确答案：E。直接松弛支气管平滑肌

解析：平喘药物包括抗炎平喘药和支气管扩张剂，抗炎平喘剂通过抑制多种参与哮喘发病的炎性细胞和免疫细胞功能以及细胞因子和炎症介质的产生；通过选择性抑制磷酸二酯酶-4发挥治疗作用。支气管扩张剂通过激动β肾上腺素受体或者抑制M胆碱受体进行支气管扩张。二者均不是直接松弛气管平滑肌来进行平喘。掌握“平喘药”知识点。